男，54岁，反复脓血便半年，每天3～4次，在当地曾按“痢疾”治疗无明显效果。近一月出现腹胀，伴阵发性腹痛。查体：消瘦，腹稍胀，质软，下腹轻压痛，右下腹可扪及一肿块，质较硬，尚可活动。首选的辅助检查
A. 大便细菌培养
B. CT
C. 钡餐检查
D. 纤维结肠镜检查
E. B超

正确答案：D。纤维结肠镜检查

解析：患者老年男性，脓血便半年，腹泻一月（属于结肠癌高危人群），伴腹痛，腹胀、质硬包块，临床症状与体征支持结肠癌诊断。为明确诊断，应行纤维结肠镜检查（D对），纤维结肠镜检查能够直接观察到肿瘤的大小，形状，肿瘤表面及周围浸润情况。大便细菌培养（A错）主要用于诊断细菌性痢疾；CT（B错）、B超（E错）可了解肿块及淋巴结转移情况，可作为辅助诊断手段；钡餐检查（C错）效果有限，不宜作为首选辅助检查。